创伤性休克的处理原则不包括
A. 安静
B. 镇痛
C. 止血
D. 抗感染
E. 补液

正确答案：D。抗感染

解析：本题考查口腔颌面部创伤急救。创伤性休克的处理原则不包括抗感染（D错，为本题正确答案）。创伤性休克的处理原则为安静（A对）、镇痛（B对）、止血（C对）和补液（E对），可用药物协助恢复和维持血压。